红外光谱图中，1650～1900cm⁻¹处有强吸收峰的基团是
A. 甲基
B. 羰基
C. 羟基
D. 氰基
E. 苯环

正确答案：B。羰基

解析：本题考查红外吸收光谱。羰基（B对）在1900～1650cm⁻¹处有较强的吸收峰。甲基（A错）为C-H键，在3000～2700cm⁻¹有吸收峰。羟基（C错）在3750～3000cm⁻¹处有强吸收峰。氰基（D错）在2400～2100cm⁻¹有吸收峰。苯环（E错）在1000～650cm⁻¹处有中等～强的吸收峰。